杀灭芽孢（胞）最有效的方法是
A. 紫外线照射
B. 巴氏消毒法
C. 干烤法
D. 流通蒸气灭菌法
E. 高压蒸汽灭菌法

正确答案：E。高压蒸汽灭菌法

解析：高压蒸汽灭菌法：应用压力蒸汽灭菌器，加压至1.05kg/cm2即温度达121.3℃，15～20分钟，可杀灭细菌芽孢（胞）和所有微生物。掌握“消毒与灭菌”知识点。